全口义齿颌位关系的确定是指
A. 恢复面部下1/3的适宜高度和两侧髁突的生理后位
B. 恢复面部生理形态
C. 确定正确的颌间距离
D. 校正下颌习惯性错误颌位
E. 确定面部垂直距离

正确答案：A。恢复面部下1/3的适宜高度和两侧髁突的生理后位

解析：本题考查颌位关系的确定。全口义齿颌位关系的确定包括确定面下部1/3的适宜高度和两侧髁突在下颌关节凹生理后位（A对）。恢复适宜的面部下1/3的垂直距离才能恢复面部生理形态（B错）。确定正确的颌间距离（C错）是为了确定面部下1/3的垂直距离（E错），而确定面部下1/3的垂直距离只是颌位关系的确定的一部分，都不够全面。校正下颌习惯性错误颌位（D错）是颌位关系记录的目的。